关于外用糖皮质激素类药物的说法，错误的是
A. 外用糖皮质激素具有抗炎、抗过敏等作用
B. 治疗全身性或严重过敏疾病时，不宜合用口服抗过敏药
C. 外用糖皮质激素可增加感染风险
D. 外用糖皮质激素不应长期、大面积应用
E. 儿童可以使用外用糖皮质激素

正确答案：B。治疗全身性或严重过敏疾病时，不宜合用口服抗过敏药

解析：本题考查外用糖皮质激素的注意事项。关于外用糖皮质激素类药物的说法，错误的是治疗全身性或严重过敏疾病时，不宜合用口服抗过敏药（B错，为本题正确答案）。治疗全身性或严重过敏疾病时，应该合用口服抗过敏药。糖皮质激素具有抗炎、抗过敏的作用（A对），对于外用糖皮质激素来说，不应长期，大面积应用（D对），可能造成对皮肤的刺激性，或增加感染风险（C对）。对于儿童来说，宜选择弱效或软性激素，如地奈德、糠酸莫米松，由于儿童皮肤薄嫩、代谢及排泄功能差，长期大面积应用也会全身吸收，产生系统不良反应，儿童使用强效激素制剂，连续使用不应超过2周（E对）。